下列属于表情肌范畴的是
A. 咬肌
B. 颞肌
C. 翼内肌
D. 翼外肌
E. 口轮匝肌

正确答案：E。口轮匝肌

解析：唇周围肌按部位分为上组、下组和口轮匝肌。属于表情肌范畴。掌握“表情肌、舌腭肌”知识点。